下列哪项属于颅脑疾病感染性抽搐
A. 脑寄生虫
B. 神经胶质瘤
C. 外伤
D. 脑挫伤
E. 脑积水

正确答案：A。脑寄生虫

解析：脑寄生虫临床表现可为急性脑膜脑炎，或为继发性癫痫发作或伴有定位体征的颅内高压症，亦可有智能衰退或精神障碍（A对）。神经胶质瘤，一部分肿瘤患者有癫痫症状，并可为早期症状。发作的原因多由于肿瘤的直接刺激或压迫所引起（B错）。头部受伤后会有脑组织受损的现象，发生癫痫抽搐（C错）。脑挫裂伤是一种脑组织、神经和血管发生不同程度、不同范围的器质性损伤。其中脑组织遭受破坏较轻，软脑膜尚完整者为脑挫伤（D错）。原有脑积水的患者的抽搐是继发性的癫痫发作。如果患者脑积水已经进行了分流手术，可能由于分流不足或者分流过度引起的，最常见的原因是分流管的堵塞（E错）。